牛奶与蛋类比较，含量相对较高的营养素是
A. 蛋白质
B. 脂肪
C. 铁
D. 钙
E. 维生素B₁

正确答案：D。钙